抑制二氢叶酸合成的药物是
A. 克拉霉素
B. 庆大霉素
C. 四环素
D. 磺胺嘧啶
E. 氧氟沙星

正确答案：D。磺胺嘧啶